根据对微波的防护原理，试判断哪种眼镜防护效果最好
A. 墨镜
B. 茶褐色玻璃眼镜
C. 金属网眼镜
D. 蓝色钻玻璃镜片
E. 普通玻璃眼镜

正确答案：C。金属网眼镜

解析：本题考查微波环境防护眼镜的选择。防护微波最好的方式是佩戴反射性防护镜片。反射性防护镜片需在玻璃镜片上涂布光亮的金属薄膜，如铬、镍、银等，形成金属网（C对ABDE错）而形成。在一般情况下，该种镜片可反射紫外线、红外线、微波等，反射率可达95%，适用于多种非电离辐射作业。